具有补肾益精，养血益气功效的药物是
A. 沉香
B. 磁石
C. 蛤蚧
D. 益智仁
E. 紫河车

正确答案：E。紫河车

解析：该题考查紫河车的功效。紫河车味甘、咸，性温，归肺、肝、肾经，其功效为补肾益精，养血益气（E对）。